患者心中烦，不得卧，口干咽燥，舌红少苔，脉细数，治宜
A. 小柴胡汤
B. 栀子厚朴汤
C. 黄连阿胶汤
D. 栀子豉汤
E. 猪苓汤

正确答案：C。黄连阿胶汤

解析：少阴心肾阴血素亏，感受外邪易从热化。心属火，位居上焦，肾属水，位居下焦。生理情况下，心火下交于肾，使肾水不寒，肾水上济于心，使心火不亢，谓之心肾相交，水火既济。若肾阴亏虚，不能上济于心，心火独亢于上则心中烦、不得卧，是谓心肾不交，水火不济。临床还当伴见口干咽燥，舌红少苔，脉沉细数等阴虚火旺的脉症。本证肾阴亏虚，心火亢旺，治宜清心火、滋肾阴、交通心肾，方用黄连阿胶汤（C对）。